麦门冬汤的功用是
A. 滋阴润肺，益气补脾
B. 养阴清肺，解毒利咽
C. 清养肺胃，降逆下气
D. 滋阴填精，益气壮阳
E. 滋阴益气，固肾止渴

正确答案：C。清养肺胃，降逆下气

解析：麦门冬汤方含麦门冬、半夏、人参、甘草、粳米、大枣。方中重用麦门冬养阴生津，滋液润燥，兼清虚热；臣以半夏降逆下气、化痰和胃；人参健脾补气，上润于肺；甘草、粳米、大枣甘润性平，合人参和中滋液；甘草调和药性。诸药合用，共奏清养肺胃，降逆下气之功（C对）。